某患者血沉增快，若将该患者的红细胞置于正常人血浆中，则其血沉速度将
A. 正常
B. 下降
C. 增快
D. 先加快后下降
E. 先下降后加快

正确答案：A。正常